女，23岁。1个月前分娩后出现失眠、心情烦躁，近2周加重，认为自己很笨，没有能力带好小孩，怕小孩夭折，觉得丈夫不再喜欢自己了，猜疑丈夫有外遇，整日以泪洗面，称不想活了，甚至要带孩子一起去死，遂入院治疗。患者最可能的诊断是
A. 分裂样障碍
B. 抑郁发作
C. 适应障碍
D. 焦虑状态
E. 妄想性障碍

正确答案：B。抑郁发作

解析：抑郁发作概括为情绪低落、思维迟缓、意志活动减退“”三低“症状，但这些重度抑郁发作时典型症状不一定出现在所有的抑郁患者中。发作应至少持续2周，并且不同程度地损害社会功能，或给本人造成痛苦或不良后果。抑郁性认知：常有”三无“症状，即无望、无助和无用。无望：想到将来，感到前途渺茫，悲观失望，预见自己的将来要出现不幸；无助：在悲观失望的基础上，常产生孤立无援的感觉，对自己的现状缺乏改变的信心和决心，认为治疗是无用的；无用：认为自己生活毫无价值，充满了失败，一无是处；抑郁性认知可有自杀观念和行为。综上所述，患者的情况符合抑郁发作（B对）。